与桡骨头关节凹相关节的是
A. 肱骨小头
B. 尺骨头
C. 肱骨滑车
D. 尺骨桡切迹
E. 尺骨滑车切迹

正确答案：A。肱骨小头

解析：肱骨小头（A对）和桡骨关节凹共同组成肱桡关节。